疾病预防控制机构对学校卫生工作的任务不包括
A. 掌握学生常见病动态
B. 掌握本地区学生生长发育和健康状况
C. 对学生使用的文具实行卫生监督
D. 对本地区学校卫生工作进行技术指导
E. 开展学校卫生服务

正确答案：C。对学生使用的文具实行卫生监督